医疗机构使用不具备相应资质的人员从事放射诊疗工作的，情节严重的应
A. 以5千元以下的罚款
B. 承担刑事责任
C. 以3千元以下的罚款
D. 吊销《医疗机构执业许可证》
E. 给予警告

正确答案：D。吊销《医疗机构执业许可证》

解析：医疗机构使用不具备相应资质的人员从事放射诊疗工作的，由县级以上卫生行政部门责令限期改正，并可以处以5千元以下的罚款；情节严重的，吊销其《医疗机构执业许可证》。掌握“放射诊疗的防护与法律责任”知识点。